患者，6岁女孩，睡中时有遗尿，劳累后尤甚，平素易感冒，面白神疲，纳少，大便时溏。舌淡苔白，脉弱。针灸取穴
A. 中极、三阴交、膀胱俞、关元、足三里、气海、肺俞
B. 中极、三阴交、膀胱俞、关元、印堂、合 谷、太冲
C. 中极、三阴交、膀胱俞、关元、足三里、四缝
D. 中极、三阴交、膀胱俞、关元、肾俞、命 门
E. 中极、三阴交、膀胱俞、关元、四缝、天枢

正确答案：A。中极、三阴交、膀胱俞、关元、足三里、气海、肺俞

解析：题干中患者遗尿，劳累后甚，肺气亏虚，卫外不固故平素易感冒；脾气亏虚，气血生化不足，则面白神疲，脾失健运，精微不布，水湿内生，故纳少腹胀，便溏，辨证为肺脾气虚遗尿，处方为中极、三阴交、膀胱俞、关元、足三里、气海、肺俞（A对）。四缝用于治疗小儿疳积、百日咳，不用于遗尿（C错）。中极、三阴交、膀胱俞、关元、肾俞、命门治疗肾阳不足型遗尿（D错）。四缝用于治疗小儿疳积、百日咳；天枢用于治疗腹痛、腹泻等胃肠疾病，月经不调等妇科疾病，都不用于遗尿（E错）。